可作为药物作用靶点的内源性生物大分子有
A. 酶
B. 核酸
C. 受体
D. 离子通道
E. 转运体

正确答案：A、B、C、D、E。酶；核酸；受体；离子通道；转运体

解析：本题考查药物作用靶点。药物与机体结合的部位就是药物作用的靶点。已知药物作用靶点涉及受体（C对）、酶（A对）、离子通道（D对）、核酸（B对）、转运体（E对）、免疫系统、基因等。此外，有些药物通过理化作用或补充体内所缺乏的物质而发挥作用。